下列不属于疖的特点的是
A. 易脓、易溃、易敛
B. 突起根浅
C. 范围多在5cm左右
D. 色红、灼热、疼痛
E. 肿势局限

正确答案：C。范围多在5cm左右

解析：疖的临床特点是色红、灼热、疼痛（D对），突起根浅（B对），肿势限局（E对），范围多小于3cm（C错，为本题正确答案），易脓、易溃、易敛（A对）。